基因突变不包括
A. 转换
B. 颠换
C. 移码突变
D. DNA大段损伤
E. 裂隙

正确答案：E。裂隙